某女，44岁，1年来，血热崩漏、月经量多，3个月前又见心血不足之心悸，失眠，健忘，宜选用的药是
A. 北沙参
B. 龟甲
C. 麦冬
D. 南沙参
E. 鳖甲

正确答案：B。龟甲

解析：本题考查的是龟甲的主治病证。1年来，血热崩漏、月经量多，3个月前又见心血不足之心悸，失眠，健忘，宜选用的药是龟甲（B对）。龟甲：【主治病证】（1）阴虚阳亢之头晕目眩，热病伤阴之虚风内动。（2）阴虚发热。（3）肾虚腰膝痿弱、筋骨不健、小儿囟门不合。（4）心血不足之心悸、失眠、健忘。（5）血热之崩漏、月经过多。北沙参（A错）：【主治病证】（1）肺热燥咳，阴虚劳嗽咯血。（2）阴伤津亏之舌干口渴。麦冬（C错）：【主治病证】（1）肺热燥咳痰黏，阴虚劳嗽咯血。（2）津伤口渴，内热消渴。（3）心阴虚、心火旺之心烦失眠。（4）肠燥便秘。南沙参（D错）：【主治病证】（1）肺热燥咳有痰，阴虚劳嗽咯血。（2）气阴两伤之舌干口渴。鳖甲（E错）：【主治病证】（1）阴虚阳亢之头晕目眩，热病伤阴之虚风内动。（2）阴虚发热。（3）久疟疟母，癥瘕。